男，25岁，头外伤昏迷5分钟后清醒，送医院途中再度陷入昏迷，伴呕吐。体检：浅昏迷，双侧瞳孔等大等圆光反射迟钝，左侧肢体肌力Ⅳ级，巴彬斯基征阳性。最可能的诊断是
A. 脑震荡
B. 脑挫裂伤
C. 硬膜外血肿
D. 硬膜下血肿
E. 脑内血肿

正确答案：C。硬膜外血肿

解析：青年男性患者，头外伤昏迷5分钟后清醒，之后再度陷入昏迷（硬膜外血肿的典型表现），体检双侧瞳孔等大等圆光反射迟钝，左侧肢体肌力IV级，巴彬斯基征阳性（原发性脑损伤的表现），结合患者的病史、症状和体格检查，最可能的诊断是硬膜外血肿（C对）。脑震荡（P188）（A错）的典型表现为伤后即刻发生短暂的意识障碍和近事遗忘，神经系统查体多无明显阳性体征。脑挫裂伤（P188）（B错）主要表现为头痛、呕吐和伤后立即发生的意识障碍，无中间清醒期。硬膜下血肿（P192）（D错）多表现为伤后持续昏迷或昏迷进行性加重，CT扫描的典型表现为脑表面新月形高密度影。脑内血肿（P194）（E错）较少见，常与伴有脑挫裂伤的复合性硬膜下血肿同时存在，CT扫描可见脑深部类圆形或不规则的高密度影。